X线片上判断牙槽骨高度降低的标准是牙槽嵴顶
A. 与釉牙骨质界平齐
B. 到釉牙骨质界的距离小于1mm
C. 到釉牙骨质界的距离小于2mm
D. 到釉牙骨质界的距离大于2mm
E. 到釉牙骨质界的距离大于3mm

正确答案：D。到釉牙骨质界的距离大于2mm

解析：正常情况之下牙槽嵴顶到釉牙骨质界的距离约为2mm，而釉牙骨质界的位置是恒定的，距离增大则表示牙槽骨高度降低。掌握“牙周疾病促进因素”知识点。